健康促进规划的评价方案形成于
A. 规划设计阶段
B. 规划实施阶段
C. 规划实施结束后
D. 规划设计、实施全过程
E. 其他方面

正确答案：D。规划设计、实施全过程